男，20岁。3年前无明显诱因渐起孤僻少语，不愿参加集体活动，甚至与父母也很少交流，上课时注意力不集中，成绩下降。个人生活懒于料理。该患者最可能的诊断为
A. 精神分裂症青春型
B. 精神分裂症单纯型
C. 精神分裂症紧张型
D. 精神分裂症偏执型
E. 精神分裂症混合型

正确答案：B。精神分裂症单纯型

解析：该青年患者，3年前（起病缓慢）无明显诱因渐起孤僻少语，不愿参加集体活动，甚至与父母也很少交流，上课时注意力不集中，成绩下降（缺乏进取心），个人生活懒于料理（生活懒散），主要以阴性症状为表现，故最可能的诊断为精神分裂症单纯型（B对）。精神分裂症青春型起病急或亚急性，患者表现为思维破裂，言语零乱，话多，喜怒无常，表情做作，好扮鬼脸，傻笑等，与本例不符（A错）。精神分裂症紧张型患者常表现紧张性兴奋和紧张性木僵交替出现，亦可单独发生，以木僵多见，本例无此症状，故不考虑（C错）。精神分裂症偏执型以妄想为主要表现，往往伴有幻觉，与本例不符（D错）。